减寿人年数是
A. PYLL
B. LEFD
C. ALE
D. DALY
E. HALE

正确答案：A。PYLL